1995年中华口腔医学会杂志社在珠海制定的种植成功标准中，要求种植体周围X线横行骨吸收不超过
A. 1/2
B. 1/3
C. 1/4
D. 2/3
E. 3/4

正确答案：B。1/3

解析：本题考查牙种植手术及效果评估。1995年中华口腔医学会杂志社在珠海制定的种植成功标准为：①功能好；②无麻木，疼痛等不适；③自我感觉良好；④种植体周围X线无透射区；横行骨吸收不超过1/3（B对），种植体不松动；⑤龈炎可控制；⑥无与种植体相关的感染；⑦对邻牙支持组织无损害；⑧美观；⑨咀嚼效率大于70%；⑩符合上述要求者5年成功率应达到85%以上；10年80%以上。